下列哪项不是遗传性乳光牙本质的病理改变
A. 牙本质小管数目减少
B. 牙本质中出现血管组织
C. 釉牙本质界呈直线
D. 牙釉质钙化不全
E. 牙髓呈急性炎症反应

正确答案：E。牙髓呈急性炎症反应

解析：本题考查遗传性乳光牙本质的病理改变。由于异常牙本质的过度形成，导致髓室、根管部分或完全消失（E错，为本题的正确答案）。遗传性乳光牙本质，近釉质的一薄层牙本质结构正常，但其余牙本质结构改变。牙本质小管数目减少（A对），牙本质中出现血管的组织（B对），为残留的成牙本质细胞和牙髓组织。釉牙本质界失去小弧形的排列而呈直线（C对），约1/3患者有釉质形成不全或钙化不全（D对）。